婴幼儿上呼吸道感染的特点错误的是
A. 高热甚至高热惊厥
B. 可伴胃肠症状腹泻
C. 常反复呼吸道感染
D. 可有充血性皮疹
E. 易合并风湿热

正确答案：E。易合并风湿热